对重度致吐化疗药所引起的恶心、呕吐，可选用的治疗药品有
A. 昂丹司琼
B. 地塞米松
C. 阿瑞吡坦
D. 多西他赛
E. 托瑞米芬

正确答案：A、B、C。昂丹司琼；地塞米松；阿瑞吡坦

解析：本题考查止吐药。对重度致吐化疗药所引起的恶心、呕吐，可选用的治疗药品有昂丹司琼（A对）、地塞米松（B对）、阿瑞吡坦（C对）；多西他赛（D错）是抗肿瘤药；托瑞米芬（E错）是抗雌激素药。